肱二头肌止于
A. 股骨小转子
B. 胫骨粗隆
C. 桡骨粗隆
D. 尺骨粗隆
E. 尺骨鹰嘴

正确答案：C。桡骨粗隆

解析：肱二头肌止于桡骨粗隆（C对）。